女，30岁，妊娠35周，发现血压升高3周，今晨突然腹痛，呈持续性，阴道有少量流血，查体P112次/分，BP150/98mmHg，子宫张力大，宫底前壁压痛明显，胎心100次/分，尿蛋白（＋＋）。此时最适宜的处理是
A. 使用硫酸镁抑制宫缩后继续妊娠
B. 给予降压止痛后密切观察
C. 给予β受体兴奋剂抑制宫缩，加强胎儿监护
D. 静脉滴注缩宫素引产
E. 剖宫产终止妊娠

正确答案：E。剖宫产终止妊娠

解析：妊娠中晚期孕妇，发现血压高(收缩压≥140mmHg和（或）舒张压≥90mmHg），蛋白尿(++），诊断为子痫前期（胎盘早剥病因）。患者今晨突发剧烈腹痛，阴道少量流血、伴有子宫张力增高和子宫压痛，据其病史、体征及实验室检查，诊断为1.子痫前期；2.胎盘早剥。查胎心100次/分（正常110～160次/分，提示胎儿窘迫），据Page分级标准诊断为Ⅱ级胎盘早剥，应及时终止妊娠（E对）。对20～34⁺⁶周合并Ⅰ级胎盘早剥的产妇，尽可能保守治疗（AC错）延长孕周。阴道分娩：适用于0～Ⅰ级患者，一般情况良好，病情较轻，以外出血为主，必要时滴注缩宫素（D错）缩短第二产程。